湿邪的性质与致病特点是
A. 耗气伤津
B. 善行数变
C. 易发肿疡
D. 凝滞主痛
E. 黏滞重浊

正确答案：E。黏滞重浊

解析：本题考查湿邪的性质及致病特点。湿邪的性质与致病特点是黏滞重浊（E对）。湿邪的性质和致病特点：湿为阴邪，易阻遏气机，损伤阳气；湿性重浊、湿性黏滞；湿性趋下，易伤阴位。暑邪的性质和致病特点：暑为阳邪，其性炎热；暑性升散，耗气伤津（A错）；暑多挟湿。风邪的性质和致病特点：风为阳邪，其性开泄，易袭阳位；风邪善行而数变（B错）；风为百病之长。火热之邪的性质和致病特点：火热为阳邪，其性炎上；火易伤津耗气；火热易生风动血；火热易发肿疡（C错）。寒邪的性质和致病特点：寒为阴邪，易伤阳气；寒性凝滞，主痛（D错）；寒性收引。